壶腹嵴将接受的刺激变成神经冲动，由何神经传入到中枢的
A. 蜗神经
B. 面神经
C. 蜗神经和前庭神经
D. 前庭神经
E. 三叉神经

正确答案：D。前庭神经

解析：内耳道底的前庭神经节的周围突分布于内耳的椭圆囊斑、球囊斑和壶腹嵴中的毛细胞，因而壶腹嵴将接受的刺激变成神经冲动后由前庭神经（D对）传入中枢。蜗神经（AC错）接受的是内耳螺旋器毛细胞传来的冲动。面神经（B错）主要接受的是舌前2/3味蕾传来的冲动。三叉神经（E错）接受的是面部及眼口鼻等处的皮肤黏膜感受器传来的冲动。